下列哪种病变引起的呕吐是中枢性的
A. 口咽刺激
B. 急性胃炎
C. 急性肝炎
D. 胃肠穿孔
E. 洋地黄中毒

正确答案：E。洋地黄中毒

解析：呕吐是通过胃的强烈收缩迫使胃或部分小肠内容物经食管、口腔而排出体外的现象。呕吐可分为反射性呕吐、中枢性呕吐以及前庭障碍性呕吐，其中中枢性呕吐可见于：①中枢神经系统疾病如脑膜炎；②全身疾病如尿毒症；③药物反应与中毒如洋地黄中毒（E对）。口咽刺激（A错）、急性胃炎（B错）、急性肝炎（C错）、胃肠穿孔（D错）主要引起反射性呕吐。